具有Krafft点的表面活性剂是
A. 十二烷基硫酸钠
B. 蔗糖脂肪酸酯
C. 脂肪酸单甘油酯
D. 脂肪酸山梨坦
E. 聚山梨酯

正确答案：A。十二烷基硫酸钠